某中学生全天能量推荐摄入量为2400kcal，按照合理营养的要求早餐应摄取的能量约为
A. 240kcal
B. 480kcal
C. 720kcal
D. 960kcal
E. 1200kcal

正确答案：C。720kcal